尘螨是室内传播疾病的重要媒介之一，常隐藏在
A. 空调机冷却塔的冷却水
B. 淋浴器、洗衣机
C. 加湿器、水龙头
D. 微波炉、计算机
E. 床铺、家具和地毯

正确答案：E。床铺、家具和地毯

解析：本题考查尘螨常隐藏在的地方。尘螨是室内传播疾病的重要媒介之一，常隐藏在床铺、家具和地毯等处（E对ABCD错）。